除另有规定外，儿科用散剂的粉末细度为
A. 粗粉
B. 中粉
C. 细粉
D. 最细粉
E. 极细粉

正确答案：D。最细粉

解析：本题考查的是散剂的质量要求。除另有规定外，儿科用散剂的粉末细度为最细粉（D对）。供制散剂的原料药均应粉碎。除另有规定外，内服散剂应为细粉（C错）；儿科用及局部用散剂应为最细粉；眼用散剂应为极细粉（E错），且应无菌。按照《中国药典》要求，细粉系指能全部通过五号筛，并含能够通过六号筛不少于95%的粉末；最细粉系指能全部通过六号筛，并含能够通过七号筛不少于95%的粉末；极细粉系指能全部通过八号筛，并含能够通过九号筛不少于95%的粉末。粗粉（A错）为不含糖块状茶剂的粉末细度要求。不含糖块状茶剂系指饮片粗粉、碎片与茶叶或适宜的黏合剂压制成块状的茶剂。粉末细度要求为中粉（B错）的剂型，2022年考试指南未明确说明。